某一特定的筛检试验，当用于患病率较高的人群时，以上叙述正确的是
A. 灵敏度升高
B. 阳性预测值升高
C. 阴性预测值升高
D. 特异度升高
E. 以上都不是

正确答案：B。阳性预测值升高